黄芪鳖甲汤适用的脱疽证候是
A. 寒湿阻络
B. 血脉瘀阻
C. 湿热毒盛
D. 热毒伤阴证
E. 气阴两虚

正确答案：E。气阴两虚

解析：寒湿阻络证用阳和汤加减（A错）。血脉瘀阻证用桃红四物汤加炮山甲、地龙、乳香、没药等（B错）。湿热毒盛证用四妙勇安汤加连翘、黄柏、丹参、川芎、赤芍、牛膝等（C错）。热毒伤阴证用顾步汤加减（D错）。气阴两虚证用黄芪鳖甲汤加减（E对）。